不能发生的是
A. 呼吸性碱中毒合并呼吸性酸中毒
B. 代谢性碱中毒合并呼吸性碱中毒
C. 呼吸性酸中毒合并代谢性酸中毒
D. 呼吸性碱中毒合并代谢性酸中毒
E. 代谢性酸中毒合并代谢性碱中毒

正确答案：A。呼吸性碱中毒合并呼吸性酸中毒

解析：呼吸性酸中毒指CO2 排出障碍或吸入过多引起的pH下降，呼吸性碱中毒是指肺通气过度引起的PaC02 降低、pH升高。由于肺不可能同时发生通气过度和通气障碍，呼吸性碱中毒合并呼吸性酸中毒（A对）不能发生。